企业建立HACCP计划的首要步骤是
A. 组建HACCP工作组
B. 描述产品
C. 确定产品的预期用途
D. 制作产品加工流程图
E. 确定关键控制点

正确答案：A。组建HACCP工作组